下列关于自然因素和社会因素对人群健康状况的影响表述正确的是
A. 自然因素对人群健康影响更为重要
B. 自然因素与社会因素的作用相同
C. 社会因素受自然因素的制约
D. 自然因素决定社会因素
E. 社会因素对人群健康的影响更为重要

正确答案：E。社会因素对人群健康的影响更为重要

解析：本题考查影响人群健康的因素。社会因素对人群健康的影响更为重要（E对ABCD错）。社会医学应用现况调查、回顾性调查，以及前瞻性研究等多种研究方法，特别是应用社会卫生服务调查的方法，研究社会制度、经济状况、文化因素、人口发展、生活劳动条件、医疗保障制度、行为生活方式和医疗卫生服务等众多社会因素对人群健康产生的积极和消极的作用，对发现的社会卫生问题进行社会病因学分析，为制定社会卫生政策提供依据。